在治疗重症希恩（Sheehan）综合征的过程中，单独使用可能诱发垂体危象
A. 雌激素
B. 孕激素
C. 氢化可的松
D. 生长激素
E. 左旋甲状腺素钠

正确答案：E。左旋甲状腺素钠

解析：治疗希恩综合征的过程中，单独使用可诱发垂体危象是左旋甲状腺素钠（E对）。因希恩综合征时垂体功能减退，身体缺少多种激素，治疗时需要在了解病人肾上腺皮质、甲状腺和性腺激素水平减退情况的基础上，选择相应的激素替代治疗。如为单一激素缺乏，则直接补充缺少的激素，但临床上多为混合型，因此大多应用多种靶腺激素联合替代治疗，剂量以生理性分泌量为度。激素补充顺序：先糖皮质激素，后甲状腺激素，以防诱发肾上腺皮质危象的发生。该病早期诊断，积极恰当地进行靶腺激素替代治疗，愈后较佳。对甲状腺素的补充，临床常用甲状腺片，应从小剂量开始，逐渐递增，如甲状腺激素初始剂量较大或增量较快，可使基础代谢率突然升高，加剧心肌耗氧量，从而诱发心绞痛，并增加肾上腺皮质功能负荷。应强调的是，本病应先补充肾上腺皮质激素，然后再用甲状腺激素或两种药物同时使用，这对于低体温的病人尤为重要。若单用甲状腺激素，可加重肾上腺皮质功能不全，甚至诱发垂体危象。当遇有严寒或病情加重时，应适当增加甲状腺激素用量，但同时也要相应调整皮质激素用量，以免导致肾上腺皮质功能不全。雌激素（A错）、孕激素（B错）、氢化可的松（C错）、生长激素（D错）单独使用一般不诱发垂体危象。